经济发展通过以下方面影响人群健康，除了
A. 提高人群的物质生活水平
B. 增加卫生投资
C. 产生现代社会病
D. 增加心理紧张因素
E. 提高劳动生产率

正确答案：E。提高劳动生产率